对急性肾盂肾炎诊断有意义的尿常规检查是
A. 上皮细胞管型
B. 白细胞管型
C. 颗粒管型
D. 红细胞管型
E. 脂肪管型

正确答案：B。白细胞管型

解析：白细胞管型表示肾小管内有炎症变化，见于急慢性肾盂肾炎（B对），间质性肾炎等。上皮细胞管型（A错）常见于肾小管坏死。红细胞管型（D错）是指管型中红细胞含量超过体积的1/3，是由于肾小球或肾小管出血所致，常见于急性肾小球肾炎、急进性肾炎、慢性肾炎、紫癜性肾炎、狼疮性肾炎等。颗粒管型（D错）多见于慢性肾炎、肾盂肾炎或某些原因引起的肾小管损伤。脂肪管型（E错）广场见于肾小管损伤、肾小管上皮细胞脂肪变性。